关于呼吸系统的描述，哪项是正确的
A. 呼吸系统的功能仅是进行气体交换
B. 呼吸系统由呼吸道和肺组成
C. 鼻、咽、喉、气管属上呼吸道
D. 主支气管以其在肺内的分支称下呼吸道
E. 肺由肺泡组成

正确答案：B。呼吸系统由呼吸道和肺组成

解析：呼吸系统由呼吸道和肺组成（B对）。呼吸系统的主要功能是进行气体交换，呼吸系统还有发音、嗅觉、神经内分泌、协助静脉血回流入心和参与体内某些物质代谢等功能（A错）。鼻、咽、喉为上呼吸道（C错）。气管和各级支气管为下呼吸道（D错）。